患者大便隐血实验阳性，说明上消化道出血量约为
A. 10ml以上
B. 60ml以上
C. 100ml以上
D. 5ml以上
E. 200ml以上

正确答案：D。5ml以上

解析：大便隐血试验是测定消化道出血的一种方法，主要用于检测肉眼不可见的少量出血，该试验对于消化道出血具有一定的鉴别诊断意义，每日消化道出血大于5ml，试验结果即显示阳性（D对）。每日出血量大于50ml，即可出现黑便。胃内积血量大于250ml可引起呕血。一次出血量小于400ml，可由组织液和脾脏贮血代偿，多不引起全身症状。出血量大于400ml可出现头晕、心悸、乏力等症状。